属于情感活动减退的症状是
A. 焦虑
B. 情感淡漠
C. 情感倒错
D. 情感低落
E. 情感脆弱

正确答案：B。情感淡漠

解析：情感淡漠是指对外界刺激缺乏相应的情感反应，缺乏内心体验，表现为情感活动的减退（B对）或丧失。焦虑是指在缺乏相应的客观刺激情况下出现的内心不安状态，表现为顾虑重重、紧张恐惧，坐立不安（A错）。情感倒错指情感表现与其内心体验或处境明显不相协调，甚至截然相反，如听到亲人去世时，却放声高歌（C错）。情感低落是负性情感活动的明显增强（D错），表现为忧愁、苦闷、唉声叹气、暗自落泪等。